奶麻的临床特点是
A. 发热3~4天出疹，出疹时热度增高
B. 发热3~4天出疹，出疹时热退
C. 发热2～3天出疹
D. 发热或无热，1～2天出疹（根盘红晕不明显）
E. 发热数小时～1天出疹

正确答案：B。发热3~4天出疹，出疹时热退

解析：幼儿急疹又称奶麻，是因感受幼儿急疹时邪，急起发热，3-4天后体温骤降，同时全身出现玫瑰红色小丘疹为特征的一种急性出疹性传染病（B对）。发热3~4天出疹，出疹时热度增高见于麻疹（A错）。发热2～3天出疹者在儿科疾病中不典型（C错）。发热或无热，1～2天出疹见于水痘，但水痘可见根盘红晕，五版教材言红晕不明显（D错）。发热数小时～1天出疹见于猩红热（E错）。